位于喉咽部的结构是
A. 咽鼓管咽口
B. 咽鼓管圆枕
C. 梨状隐窝
D. 咽隐窝
E. 咽扁桃体

正确答案：C。梨状隐窝

解析：咽鼓管咽口(A错)、咽鼓管圆枕(B错)、咽隐窝(D错)、咽扁桃体(E错)(P102)均位于鼻咽部，梨状隐窝(C对)位于喉咽部。